男，30岁。反复右下腹痛1年，伴便秘，口腔溃疡，无发热及乏力。否认结核病史及结核密切接触史。查体：右下腹可触及边界不清的包块，可移动，压痛阳性。首先考虑的诊断是
A. 肠结核
B. 克罗恩病
C. 结肠癌
D. 阑尾炎
E. 结核性腹膜炎

正确答案：B。克罗恩病

解析：中青年男性患者，反复右下腹痛（克罗恩病腹痛多位于右下腹或脐周）1年，伴便秘，口腔溃疡（克罗恩病的肠外表现）。查体：右下腹（克罗恩病的好发部位为回肠末段）可触及边界不清的包块（腹部包块见于10％～20％的克罗恩病患者），可移动，压痛阳性。综合该患者的病史及查体，考虑诊断为克罗恩病（B对）。肠结核（P368）（A错）多有结核病史及发热、盗汗、乏力等结核毒血症状。结肠癌（P382）（C错）发病年龄多在40～60岁，多有血便，可有腹部肿块，但提示已届中晚期，会有进行性消瘦、恶病质、腹水等表现。慢性阑尾炎（九版外科学P377）（D错）既往常有急性阑尾炎发作病史，剧烈活动或饮食不节可诱发，主要体征是阑尾部位局限性压痛，体检可在右下腹扪及阑尾条索。结核性腹膜炎（P370）（E错）应有结核原发病灶，常有脐周、下腹或全腹隐痛，腹部触诊有揉面感，腹部肿块以脐周为主。